下列属于甲状旁腺激素作用的是
A. 抑制肾小管磷的重吸收
B. 抑制肾小管钙的重吸收
C. 抑制活性维生素D的合成
D. 抑制肠道钙吸收
E. 抑制破骨细胞的活性

正确答案：A。抑制肾小管磷的重吸收

解析：甲状旁腺激素（PTH）对肾的作用主要是抑制近端和远端小管重吸收磷（A对），降低血磷；促进肾远曲小管和集合管重吸收Ca²⁺（B错），升高血钙。PTH对骨的生物效应取决于应用的方式和量，持续应用可诱导破骨细胞增殖、融合、发育以及活性的增强（E错）；小量、间歇应用则表现骨形成为主；降钙素（P401）能直接迅速抑制破骨细胞的活性。PTH可诱导1α-羟化酶基因转录，促进维生素D的活化（C错）合成钙三醇，钙三醇合成增加时可负反馈抑制1α-羟化酶的活性。抑制肠道钙吸收（D错）的是降钙素，PTH促进肠道钙吸收。